与鼻咽癌的发生有关的是
A. HSV-1
B. HSV-2
C. VZV
D. CMV
E. EBV

正确答案：E。EBV